下列关于经常性卫生监督论述错误的是
A. 地方性劳动卫生监督机构进行的工作
B. 对现有企业贯彻执行卫生法规和卫生标准情况的监督
C. 随时或定期进行监督
D. 根据监督检查结果作出相应处理
E. 监督检查数据是制定卫生标准的依据

正确答案：E。监督检查数据是制定卫生标准的依据